患者，女，42岁。肛门部肿物，异物感明显，时肿痛。经查可见截石位3、7、11点为静脉曲张性外痔。应首选的治疗措施是
A. 注射法
B. 枯痔法
C. 结扎
D. 切除法
E. 外剥内扎法

正确答案：D。切除法

解析：静脉曲张性外痔是齿状线以下的痔外静脉丛发生扩大曲张，在肛缘形成的柔软团块，以肛门不适为主要症状，彻底治疗应作静脉丛剥离术（D对）。注射法用于Ⅰ、Ⅱ、Ⅲ期内痔，内痔兼有贫血者，混合痔的内痔部分（A错）。枯痔法用于各期内痔及混合痔的内痔部分（B错）。结扎法用于Ⅱ～Ⅳ期内痔及混合痔的内痔部分（C错）。外剥内扎法用于混合痔（E错）。